既有速释又有缓释作用的栓剂是
A. 泡腾栓剂
B. 渗透泵栓剂
C. 凝胶栓剂
D. 双层栓剂
E. 微囊栓剂

正确答案：D。双层栓剂

解析：本题考查栓剂。双层栓剂（D对）：一种是内外层含不同药物，另一种是上下两层，分别使用水溶性或脂溶性基质，将不同药物分隔在不同层内，通过控制各层的溶化，使药物具有不同的释放速度，可速释可缓释；泡腾栓剂（A错）是利用泡腾原理制备的栓剂，可迅速释放药物；渗透泵型栓剂（B错）是利用渗透泵原理制备的栓剂，属于缓、控释栓剂；凝胶栓剂（C错）中亲水凝胶遇水膨胀后形成凝胶屏障控制药物的释放，属于缓释型栓剂；微囊栓剂（E错）中药物以微囊的形式存在于栓剂中，属于缓、控释栓剂。